环孢素引起的药源性疾病
A. 急性肾衰竭
B. 横纹肌溶解
C. 中毒性表皮坏死
D. 心律失常
E. 听力障碍

正确答案：A。急性肾衰竭

解析：本题考查药源性疾病。环孢素引起急性肾衰竭（A对）；他汀类能够引起横纹肌溶解（B错）；中毒性表皮坏死（C错）可能由磺胺类、非留体抗炎药等引起；强心苷类引起心律失常（D错）；听力障碍（E错）可能由氨基糖苷类、非甾体抗炎药等引起。